未经煮熟的大豆所含的有害成分是
A. 抗生物素
B. 抗胰脂肪酶
C. 抗胃蛋白酶
D. 抗糜蛋白酶
E. 抗胰蛋白酶

正确答案：E。抗胰蛋白酶